属于替牙期间的暂时性错（牙合）是
A. 额外牙导致上颌左右中切牙萌出早期出现间隙
B. 上下恒切牙萌出早期，可出现前牙反（牙合）
C. 上颌侧切牙初萌时，牙冠向近中倾斜
D. 上下颌第一恒磨牙建（牙合）初期，为完全远中关系
E. 待侧切牙萌出，间隙逐渐消失

正确答案：E。待侧切牙萌出，间隙逐渐消失

解析：本题考查（牙合）的生长发育。属于替牙期间的暂时性错（牙合）是待侧切牙萌出，间隙逐渐消失（E对）。替牙期间左、右中切牙之间往往有一间隙，待侧切牙萌出，间隙逐渐消失，中切牙位置转为正常。